两侧瞳孔大小不等,多见于
A. 有机磷农药中毒
B. 阿托品类药物影响
C. 吗啡药物影响
D. 濒死状态
E. 脑肿瘤

正确答案：E。脑肿瘤

解析：双侧瞳孔大小不等，多见于脑外伤、脑肿瘤（E对）、中枢神经梅毒、脑疝等。有机磷农药中毒（A错）、吗啡药物影响（C错）表现为双侧瞳孔缩小。阿托品类药物影响表现为双侧瞳孔扩大（B错）。濒死状态表现为双侧瞳孔散大并伴有对光反射消失（D错）。